甲亢危象选用
A. 甲基硫氧嘧啶
B. 丙基硫氧嘧啶
C. 甲状腺素
D. ¹³¹I
E. 甲巯咪唑

正确答案：B。丙基硫氧嘧啶